健康人的空腹血糖范围在3.9～6.1mmol/L，糖尿病患者的空腹血糖范围一般≥7.0mmol/L，在用血糖值初筛糖尿病患者时，为了尽可能避免漏诊与误诊，可将截断值选择在
A. 3.9
B. 6.1
C. 7
D. （3.9+7.0）/2
E. （6.1+7.0）/2

正确答案：E。（6.1+7.0）/2

解析：本题考查截断值的选择。一般而言，筛检试验应综合考虑灵敏度和特异度达到平衡，此时将临界点定在非病人与病人的分布曲线交界处。健康人的空腹血糖范围在3.9～6.1mmol/L，糖尿病患者的空腹血糖范围一般≥7.0mmol/L，为了尽可能避免漏诊与误诊，可将截断值选择在（6.1+7.0）/2（E对ABCD错）。